肾功能不全者慎用的是
A. 三七
B. 草乌
C. 艾叶
D. 川楝子
E. 五倍子

正确答案：B。草乌

解析：本题考查的是常见对肾功能有影响的植物类中药。肾功能不全者慎用的是草乌（B对）。常见对肾功能有影响的植物类中药：（1）含生物碱类：近年来发现，不但雷公藤、草乌、益母草、蓖麻子、麻黄、北豆根等均可导致急性肾功能衰竭，而且含上述中药的一些制剂也可引起肾损害甚至急性肾功能衰竭。（2）含马兜铃酸类：马兜铃、天仙藤、寻骨风等均含马兜铃酸，中毒可致肾小管坏死出现面部浮肿，渐至全身水肿、尿频尿急，甚至出现急、慢性肾功能衰竭及尿毒症而死亡。（3）含挥发油类：部分芳香类药物的肾毒性可能与其挥发油类成分相关，如土荆芥、藿香、茵陈、艾叶等。（4）含蒽醌类：研究显示，大黄蒽醌类成分（大黄、番泻叶、芦荟）具有潜在的肝肾毒性和致癌性。（5）苷类：苍耳子含苍术苷或羧基苍术苷可导致近端肾小管坏死、肝中心小叶坏死。三七（A错）、艾叶（C错）、川楝子（D错）、五倍子（E错）为肝功能不全者慎用药。引起肝损伤的植物类中药及其主要化学物质：文献报道多、有明确肝损伤的中药有柴胡、川楝子、苍术、苍耳子、栀子、吴茱萸、艾叶、山豆根、番泻叶、何首乌、黄药子、雷公藤等。其肝毒性与所含成分有关。（1）生物碱类：菊科的千里光属（如千里光、菊三七等）、款冬属、蜂斗菜属、泽兰属，紫草科的紫草属、天芥菜属。（2）苷类：含皂苷的中药有三七、商陆、黄药子等，黄药子是目前公认的肝脏毒性中药。（3）毒蛋白类：如苍耳子、蓖麻子、望江南子、相思豆等。（4）多肽类：毒蕈植物中毒蕈伞。（5）萜与内酯类：包括有川楝子、黄药子、艾叶等，其中川楝子是含萜类肝脏毒性中药中最典型的一类药物。（6）鞣质类：包括五倍子、石榴皮、诃子等。